若用图直观地表示某城市在8年中肝炎的发病率随时间的变化情况，宜选择
A. 散点图
B. 普通线图
C. 直条图
D. 直方图
E. 圆图

正确答案：B。普通线图